应用十八烷基硅烷键合硅胶为填充剂，以0.05mol/l磷酸二氢钾溶液（pH5.0）-乙腈（97.5:2.5）为流动相，检测波长为254nm测定的项目是
A. 维生素KI的含量测定
B. 硝酸士的宁的含量测定
C. 阿莫西林的含量测定
D. 维生素C的含量测定
E. 硫酸庆大霉素的含量测定

正确答案：C。阿莫西林的含量测定